乳牙列中，龋好发牙位
A. 下颌乳磨牙
B. 上颌乳磨牙
C. 乳尖牙
D. 乳中切牙
E. 乳侧切牙

正确答案：A。下颌乳磨牙

解析：本题考查乳牙龋。乳牙列中，龋好发牙位为下颌乳磨牙（A对）。乳牙列中，患龋率最高的是下颌第二乳磨牙，其次是上颌第二乳磨牙、第一乳磨牙、上颌乳前牙、下颌乳前牙。乳牙龋病好发牙面为乳切牙的近中面和唇面，乳尖牙的唇面和远中面，第一乳磨牙的咬合面和远中面，第二乳磨牙的咬合面和近中面。乳牙患龋成对称性，左右同名牙可同时患龋。